结核菌素试验假阴性反应不包括
A. 部分危重结核病患者
B. 结核变态反应前期（初次感染后4～8周）
C. 急性传染病
D. 原发或继发免疫缺陷病
E. 应用肾上腺皮质激素治疗时

正确答案：B。结核变态反应前期（初次感染后4～8周）

解析：人体感染结核分枝杆菌后，产生免疫力的同时也会发生迟发型超敏反应。将一定量的结核菌素注入皮内，如受试者曾感染结核分枝杆菌，则在注射部位会出现迟发型超敏反应，判为阳性，未感染结核杆菌的则为阴性。对于部分危重结核病患者（A对）、急性传染病（C对）、原发或继发免疫缺陷病（D对）、应用肾上腺皮质激素（E对）治疗时机体的免疫功能低下，不会使机体产生超敏反应，使实验结果出现假阴性。结核变态反应前期时，机体超敏反应尚未产生，4～8周后才建立充分的变态反应，注射结核菌素后试验阴性，但不是假阴性反应（B错，为本题正确答案）。